脾破裂术前最重要的治疗措施是
A. 止痛
B. 补充血容量
C. 控制感染
D. 应用止血药
E. 补充营养

正确答案：B。补充血容量

解析：脾脏为腹腔实质性器官，质脆，血流量大，损伤后伤口难以自行止血，出血量极大，很容易导致休克，引起全身各脏器及组织缺血，因此，术前最重要的治疗措施是补充血容量（B对），防治休克。给予镇静或止痛药（A错）、应用抗生素控制感染（C错）、应用止血药（D错）、补充营养（E错）为一般性对症治疗，不是术前最重要的治疗措施。